蛋白尿的定义是24小时尿蛋白超过
A. 150mg
B. 100mg
C. 200mg
D. 250mg
E. 300mg

正确答案：A。150mg

解析：正常人由于肾小球滤过膜的滤过作用和肾小管的重吸收作用，尿中蛋白质的含量很少，蛋白定性呈阴性反应，定量小于80mg/24小时。当尿蛋白定性试验阳性或尿蛋白定量大于100mg/L或大于150mg/24小时（A对），称蛋白尿。如果尿蛋白含量≥3500mg/24h，则称为大量蛋白尿。